呈不规则形的小块，外表面黄棕色至黄褐色，碎断面淡黄色并具金属光泽的饮片是
A. 自然铜
B. 赭石
C. 雄黄
D. 煅炉甘石
E. 生石膏

正确答案：A。自然铜

解析：本题考查的是自然铜药材的性状鉴别。呈不规则形的小块，外表面黄棕色至黄褐色，碎断面淡黄色并具金属光泽的饮片是自然铜（A对）。自然铜：【性状鉴别】药材晶型多为立方体，集合体呈致密块状。表面亮淡黄色，有金属光泽；有的黄棕色或棕褐色，无金属光泽。具条纹，条痕绿黑色或棕红色。体重，质坚硬或稍脆，易砸碎，断面黄白色，有金属光泽；或断面棕褐色，可见银白色亮星。赭石（B错）：【性状鉴别】药材为鲕状、豆状、肾状集合体。多呈不规则的扁平块状。暗棕红色或灰黑色，条痕樱红色或红棕色，有的有金属光泽。一面多有圆形的突起，习称“钉头”；另一面与突起相对应处有同样大小的凹窝。体重，质硬，砸碎后断面显层叠状。气微，味淡。雄黄（C错）：【性状鉴别】药材为块状或粒状集合体，呈不规则块状。深红色或橙红色，条痕淡橘红色，晶面有金刚石样光泽。质脆，易碎，断面具树脂样光泽。微有特异臭气，味淡。精矿粉为粉末状或粉末集合体，质松脆，手捏即成粉，橙黄色，无光泽。煅炉甘石（D错）：【性状鉴别】呈白色、淡黄色或粉红色的粉末；体轻，质松软而细腻光滑。气微，味微涩。生石膏（E错）：【性状鉴别】药材为纤维状的集合体。呈长块状、板块状或不规则块状。白色、灰白色或淡黄色，有的半透明。体重，质软，纵断面具绢丝样光泽。气微，味淡。